以下关于口底癌的描述，哪一项是错误的
A. 在我国比较少见
B. 多为中度分化的鳞状细胞癌
C. 生长于口底前部者，其恶性程度较后部为高
D. 早期浅表的口底鳞癌可用放射治疗
E. 口底癌常早期发生淋巴结转移，转移率仅次于舌癌

正确答案：C。生长于口底前部者，其恶性程度较后部为高

解析：口底癌与西方国家比较，我国的口底癌较为少见。早期常发生于舌系带的一侧或中线两侧，多为中度分化的鳞状细胞癌。生长于口底前部者，其恶性程度较后部为低。掌握“颊癌、口底癌及唇癌”知识点。